佝偻病颅骨软化多发生于
A. 3～6个月
B. 5～9个月以后
C. 6个月以后
D. 2岁以后
E. 3岁以后

正确答案：A。3～6个月

解析：本题考查维生素D缺乏性佝偻病的相关病征。维生素D缺乏性佝偻病初期的婴儿若未及时治疗，病程继续加重，导致PTH功能持续增强，出现钙、磷代谢失常的典型骨骼改变。维生素D缺乏性佝偻病颅骨软化多发生于3～6月龄（A对BCDE错）婴儿，表现为前卤边较软，颅骨变薄。